关于麻风分枝杆菌，下列说法错误的是
A. 具有抗酸性
B. 典型胞内菌
C. 不能体外人工培养
D. 不具耐药性
E. 可为持久菌

正确答案：D。不具耐药性